设两个定性因素为A和B，每个因素的两水平分别用“+”和“-”表示有无，则配对四格资料是检验
A. A+B-与A-B+差别
B. A+B+与A-B-差别
C. A+A+与B+B+差别
D. A-A-与B+B+差别
E. A-A-与B-B-差别

正确答案：A。A+B-与A-B+差别